从挥发油的乙醚溶液中萃取酚性成分应使用
A. 1％硫酸溶液
B. 5％盐酸溶液
C. 2%氢氧化钠溶液
D. 20%硝酸银溶液
E. 氯化钠水溶液

正确答案：C。2%氢氧化钠溶液